颅骨的薄弱点是
A. 额、顶、颞、蝶四骨的会合处
B. 颞骨鼓部
C. 颞骨鳞部
D. 颞线中点处
E. 上项线中点处

正确答案：A。额、顶、颞、蝶四骨的会合处

解析：颞窝前下部较薄，在额、顶、颞、蝶骨汇合处最为薄弱，此处常构成 H 形的缝，称翼点（A对）。